上颌第一磨牙舌尖与（牙合）平面的距离是
A. 近中舌尖0mm，远中舌尖0.5mm
B. 近中舌尖0mm，远中舌尖1mm
C. 近中舌尖0mm，远中舌尖1.5mm
D. 近中舌尖1mm，远中舌尖0.5mm
E. 近中舌尖1mm，远中舌尖2mm

正确答案：B。近中舌尖0mm，远中舌尖1mm

解析：本题考查上颌第一磨牙舌尖与（牙合）平面的距离。上颌磨牙的舌尖是功能尖，与下颌义齿的颊尖发生咬合。上颌第一磨牙近舌尖接触（牙合）平面，远舌尖离开（牙合）平面1mm（B对），符合上颌纵（牙合）曲线的凸向下的曲面形态，有利于义齿达到平衡（牙合）。若上颌近中舌尖高出（牙合）平面，远中舌尖离开（牙合）平面不足1mm（AD错），会导致上颌义齿后牙过高，前牙开（牙合）。若颌近中舌尖低于（牙合）平面，远中舌尖离开（牙合）平面超出1mm（CE错），上颌义齿后牙过低，前牙深覆（牙合），不利于义齿的平衡（牙合）。